小儿化食丸除消食化滞外，又能
A. 驱虫
B. 清燥润肺
C. 清热肃肺
D. 清热凉肝
E. 泻火通便

正确答案：E。泻火通便

解析：本题考查的是小儿化食丸的功能。小儿化食丸除消食化滞外，又能泻火通便（E对）。小儿化食丸：【功能】消食化滞，泻火通便。肥儿丸：【功能】健胃消积，驱虫（A错）。二母宁嗽丸：【功能】清肺润燥（B错），化痰止咳。小儿消积止咳口服液：【功能】清热肃肺（C错），消积止咳。功能为清热凉肝（D错）的中成药，2022年考试指南未明确说明。